下列哪一个机制能解释上运动神经元损伤后所产生反射亢进
A. 损伤去除了皮质脊髓束对牵张反射的抑制作用
B. 痉挛是由于对γ运动神经元的抑制作用减弱
C. 直接增强α运动神经元的功能
D. 取消小脑对牵张反射的抑制作用
E. 运动神经元受刺激后，增强了高尔基腱器的功能

正确答案：A。损伤去除了皮质脊髓束对牵张反射的抑制作用

解析：上运动神经元损伤后的产生的深反射亢进是由于失去高级控制所致，即损伤去除了皮质脊髓束对牵张反射的抑制作用，直接增强α运动神经元的功能（C对）。浅反射（如腹壁反射、提睾反射等）减弱是因锥体束的完整性被破坏所致。